患者女，27岁产后2周，高热汗出，烦躁，斑疹隐隐，舌红绛，苔黄燥，脉弦细而数化验血：20×10⁹/L治疗首选的方剂是
A. 解毒活血汤
B. 大黄牡丹皮汤
C. 清营汤
D. 安宫牛黄丸
E. 五味消毒饮

正确答案：C。清营汤

解析：患者产后高热汗出，烦躁，斑疹隐隐，舌红绛，苔黄燥，脉弦细而数。是由于感染邪毒不解，火热炽盛，加之产后元气大伤，邪毒内陷，热入营血，与血搏结，损伤营阴，或迫血妄行可致发热，属热入营血证，选方清营汤（C对）。解毒活血汤主治温暑痧邪，深入营分，转筋吐下，肢厥汗多，脉伏溺无，口渴腹痛，面黑目陷，势极可危之症（A错）。大黄牡丹皮汤具有泻热破瘀，散结消肿的功效（B错）。安宫牛黄丸用于热病，邪入心包，高热惊厥，神昏谵语；中风昏迷及脑炎、脑膜炎、中毒性脑病、脑出血、败血症（D错）。产褥感染感染邪毒证用五味消毒饮（E错）。